下列有关可摘局部义齿基牙的选择说法不正确的是
A. 选择健康牙作基牙
B. 切牙一般可以选作基牙
C. 牙槽突吸收到根长的1/2不宜单独作基牙
D. 越近缺隙的牙作基牙，固位、支持效果越好
E. 牙周治疗后可用联冠、连续卡环等方式加强后作基牙

正确答案：B。切牙一般可以选作基牙

解析：选择基牙的原则：①选择健康牙作基牙。牙周健康，牙周膜面积大的牙齿为首选的基牙。切牙牙周膜面积小，又与美观有关，故一般不选作基牙。②虽有牙体疾病但已经治疗或修复者。③虽有牙周疾病但已经治疗并得到控制者。如牙槽突吸收到根长的1/2或松动达二度的牙齿不宜单独作基牙；经牙周治疗后，病情得到控制，可用联冠、连续卡环等方式加强后作基牙或作覆盖基牙。④越近缺隙的牙作基牙，固位、支持效果越好。⑤选用多个基牙时，彼此愈分散愈好。这可使每个基牙和就位道所成的交角较大，有利于增强固位。掌握“局部义齿的设计”知识点。